千年健的功效是
A. 祛风湿，强筋骨
B. 祛风湿，利小便
C. 祛风湿，解热毒
D. 祛风湿，通经络
E. 祛风湿，降血压

正确答案：A。祛风湿，强筋骨

解析：本题考查的是千年健的功效。千年健的功效是祛风湿，强筋骨（A对）。千年健：【功效】祛风湿，强筋骨。青风藤：【功效】祛风湿，通经络（D错），利小便（B错）。豨莶草：【功效】祛风湿，通经络，清热解毒（C错），降血压（E错）。